一尿闭患者入院时留置导尿管，两日后出现低血压和发热，尿中有大是白细胞和细菌，血气分析为：pH7.32,PaCO₂2.67kPa(20mmHg),HCO₃⁻10mmol/L,其酸碱紊乱类型为
A. 代谢性酸中毒
B. 呼吸性酸中毒
C. 代谢性酸中毒合并呼吸性酸中毒
D. 代谢性酸中毒合并呼吸性碱中毒
E. 呼吸性碱中毒

正确答案：D。代谢性酸中毒合并呼吸性碱中毒

解析：pH7.32<7.35可判定为酸中毒，引起酸中毒的原因可能有PaCO₂增高或HCO₃⁻下降，由于患者HCO₃⁻（正常为22~27 mmoI/L）降低，故可判断为代谢性酸中毒，根据单纯型酸碱平衡紊乱的代偿公式，HCO₃⁻每降低1mmol/L, PaCO₂降低1.2mmHg。该患者HCO₃⁻降低24-10=14mmoVL, PaCO₂应降低14x1.2=16.8±2mmHg,患者如是单纯型代谢性酸中毒，其PaCO₂应为40-16.8±2= 21.2~ 25.2mmHg, 此患者PaCO₂ 为20mmHg低于代偿预计值，表明患者是代谢性酸中毒合并呼吸性碱中毒（D对），为混合型酸碱平衡紊乱。